下列关于口服阿仑膦酸钠使用注意事项的说法，错误的是
A. 口服后30分钟内应保持立位或坐位
B. 应避免同时使用两种双膦酸盐
C. 随餐服用，并大量饮水，可增加吸收、减少胃肠道刺激
D. 食管炎为典型不良反应
E. 已批准用于提早绝经女性骨质疏松的防治

正确答案：C。随餐服用，并大量饮水，可增加吸收、减少胃肠道刺激

解析：本题考查服用双膦酸盐的注意事项。阿仑膦酸钠宜于早晨空腹给药（C错，为本题正确答案）。为减少不良反应，不要同时使用2种双膦酸盐类药（B对）。建议用足量水送服，保持上身直立的坐位或者站位，服后30min内不宜进食和卧床（A对）。阿仑膦酸钠已被批准用于绝经女性OP的防治（E对），主要不良反应为食管炎（D对）。